起于胞中的三条经脉是
A. 冲、任、督
B. 冲、任、带
C. 任、督、带
D. 督、冲、带
E. 阴跷、带、任

正确答案：A。冲、任、督

解析：奇经八脉中的督脉、任脉、冲脉（A对）皆起于胞中，同出于会阴，而分别循行于人体的前后正中线和腹部两侧，故称为“一源三歧”。